用于非缺隙侧后牙上的卡环是
A. 对半卡环
B. 圈形卡环
C. 三臂卡环
D. 回力卡环
E. 联合卡环

正确答案：E。联合卡环

解析：本题考查卡环的种类及适用。用于非缺隙侧后牙上的卡环是联合卡环（E对）。1.联合卡环：由位于相邻两基牙上的2个卡环通过共同的卡环体相连而成。此卡环需用铸造法制作。卡环体位于相邻两基牙的外展隙，并与伸向（牙合）面的（牙合）支托相连接。适用于基牙牙冠短而稳固，相邻两牙之间有间隙或有食物嵌塞等情况者。2.对半卡环（A错）：由颊、舌侧两个相对的卡环臂和近、远中两个（牙合）支托所组成，以各自的小连接体分别连接于树脂基托中或铸造支架上。注意应将其中一个卡环臂设计为对抗臂，不宜将两个卡环臂都设计为固位臂。主要用于前后有缺隙、孤立的前磨牙或磨牙。3.环形卡环：亦称圈形卡环（B错），多用于最后孤立的磨牙上，基牙向近中舌侧（多为下颌）或近中颊侧（多为上颌）倾斜。4.三臂卡环（C错）由颊、舌两臂及支托组成。多用于牙冠外形好，无明显倾斜的基牙。5.回力卡环（D错）：常用于后牙游离端缺失，基牙为前磨牙或尖牙，牙冠较短或呈锥形。